白茅根的功效是
A. 凉血止血，清热利尿
B. 凉血止血，活血化瘀
C. 收敛止血，清热生津
D. 化瘀止血，清热利尿
E. 收敛止血，祛痰止咳

正确答案：A。凉血止血，清热利尿

解析：本题考查的是白茅根的功效。白茅根的功效是凉血止血，清热利尿（A对）。白茅根：【功效】凉血止血，清热生津，利尿通淋。大黄：【功效】泻下攻积，清热泻火，解毒止血，活血祛瘀（B错）。半枝莲：【功效】清热解毒，散瘀止血，利水消肿（D错）。侧柏叶：【功效】凉血止血，祛痰止咳（E错），生发乌发。功效为收敛止血，清热生津（C错）的中药，2022年考试指南未明确说明。